下列哪项不适于慢性盆腔炎的综合治疗
A. 加强营养与锻炼，提高机体抵抗力
B. 物理治疗，如超短波、蜡疗、离子透入
C. 针灸及穴位注射
D. 反复静脉滴注抗生素
E. 中药热敷及保留灌肠

正确答案：D。反复静脉滴注抗生素

解析：慢性盆腔炎抗生素治疗需根据药敏实验经验选用抗生素，要求足量，但不是反复静脉滴注（D错，为本题正确答案），且需注意毒性反应，同时应根据综合因素，实现抗生素的个体化选药方案。盆腔炎性疾病后遗症平时应注意提高机体免疫力，增强体质（A对）；物理疗法中常用的有短波、离子透入、蜡疗等（B对）；中医外治包括针灸及穴位注射刺激局部炎症吸收（C对）、中药保留灌肠及中药热敷（E对）。